需要进行崩解时限检查的片剂是
A. 含片
B. 咀嚼片
C. 缓释片
D. 控释片
E. 半浸膏片

正确答案：E。半浸膏片

解析：本题考查片剂的质量要求。需要进行崩解时限检查的片剂是半浸膏片（E对）。片剂崩解时限：除另有规定外，药材原粉片6片均应在30分钟内全部崩解；浸膏（半浸膏）片、糖衣片各片均应在1小时内全部崩解。薄膜衣片在盐酸溶液（9→1000）中检查，化药片应在30分钟内全部崩解；中药片应在1小时内全部崩解。含片（A错）的溶化性照崩解时限检查法检查，各片均不应在10分钟内全部崩解或溶化。咀嚼片（B错）、以冷冻干燥法制备的口崩片以及规定检查溶出度、释放度的片剂，一般不再进行崩解时限检查。片剂释放度：缓释片（C错）、控释片（D错）和肠溶片以及经肠溶材料包衣的颗粒制成的口崩片应进行释放度检查。